根据《中华人民共和国价格法》，经营者销售商品，可以不注明商品的
A. 品名
B. 等级
C. 成分
D. 价格
E. 计价单位

正确答案：C。成分